患者男，48岁。近八个月来感觉。烦躁不安饥饿伴精神症状。近两个月来经常有晨起昏迷。服用糖水后清醒。发作时血糖1.8～2.2mmol/L。否认既往有高血压糖尿病史。急诊入院查体，呼吸18次/分。血压120/80mmHg，脉搏94次/分。双肺听诊无干湿啰音。无异常心音。腹部平软无压痛反跳痛。患者最可能的病因为
A. 胰岛素瘤
B. 二型糖尿病
C. 胰岛素抵抗
D. 反应性低血糖
E. 自主神经功能紊乱

正确答案：A。胰岛素瘤

解析：患者有典型Whipple三联征表现，即低血糖症状（大脑神经元低血糖症状：精神症状、甚至昏迷）、发作时血糖<2.8mmol/L（1.8-2.2mmol/L）、给予糖水后症状缓解。且患者晨起时昏迷，考虑为胰岛素瘤（A对）。糖尿病（B错）可发生酮症酸中毒昏迷或高渗性昏迷，但进糖水后只会加重病情，而不会逐渐缓解而清醒。胰岛素抵抗（C错）血糖升高，进糖水会加重病情。反应性低血糖（D错）多表现为餐后低血糖，而不是饥饿后低血糖。自主神经功能紊乱（E错）不会出现昏迷症状。